女，25岁，主诉牙齿松动，刷牙时常出血，检查发现牙龈肿胀，大腿外侧有皮下出血瘀斑。患者可能缺乏
A. 维生素A
B. 维生素B₁
C. 维生素B₂
D. 烟酸
E. 维生素C

正确答案：E。维生素C